利尿药物中，可用于治疗尿崩症的是
A. 呋塞米
B. 依他尼酸
C. 螺内酯
D. 氨苯蝶啶
E. 氢氯噻嗪

正确答案：E。氢氯噻嗪

解析：氢氯噻嗪（E对）可用于尿崩症，其机制主要是氢氯噻嗪对磷酸二酯酶具有抑制作用，能增加远曲小管及集合管细胞内cAMP的含量，后者能提高远曲小管对水的通透性，同时因增加钠离子、氯离子的排出，造成负氮平衡，血浆渗透压下降，从而减轻病人的渴感而减少饮水量，使尿量减少。呋塞米（A错）与依他尼酸（B错）均属于高效利尿药，可迅速增加全身静脉血容量，减轻肺淤血，缓解心力衰竭，临床主要用于急性肺水肿和脑水肿以及其他严重水肿，还可以用于急性肾衰竭和加速毒物的排泄。螺内酯（C错）属于醛固酮拮抗药，为低效的利尿药，仅在体内有醛固酮存在时才发挥作用，临床主要用于治疗醛固酮升高有关的顽固性水肿以及充血性心力衰竭。氨苯蝶啶（D错）属于钠离子通道阻滞剂类利尿药，具有排钠、利尿、保钾的作用，临床可与排钾利尿药合用于治疗顽固性水肿。